《化学文摘》的英文缩写是
A. CPA
B. IPA
C. BA
D. CA
E. IM

正确答案：D。CA